痹证日久引起心悸，其主要病机是
A. 心阳不振
B. 瘀血阻络
C. 水饮凌心
D. 心血不足
E. 阴虚火旺

正确答案：B。瘀血阻络

解析：痹证日久，复感外邪，内舍于心，痹阻心脉，心血运行受阻，引起心悸。此病理变化是邪恋经络，气血痹阻不通，因此瘀血阻络是心痹最主要的病理变化（B对）。心阳不振致心阳虚衰，无以温养心神会引起心悸；水饮凌心，脾肾阳虚，水饮内停，上凌于心，扰乱心神也会引起心悸；心血亏耗，心血不足，心失所养，心神不宁会引起心悸；肝肾阴虚，水不济火，心火内动，阴虚火旺，扰动心神，引起心悸；但都不是痹证日久引起心悸的主要病机（ACDE错）。